寒凉性对人体的不良作用是
A. 助火
B. 耗气
C. 伤阳
D. 敛阴
E. 伤津

正确答案：C。伤阳

解析：本题考查的是药物四气的所示效用。寒凉性对人体的不良作用是伤阳（C对）。四气，从本质而言只有寒热二性。凡寒凉性药物，即表示其具有清热、泻火、凉血、解热毒等作用；凡温热性药物，即表示其具有温里散寒、补火助阳、温经通络、回阳救逆等作用。四气对人体的作用也有两面性，倘若应用不当，即可对人体产生不良作用。此时，寒凉性有伤阳助寒之弊，而温热性则有伤阴助火（A错）之害。耗气（B错）是辛味药的不良作用。辛味药大多能耗气伤阴，气虚阴亏者慎用。敛阴（D错）属于针对八纲辨证的功效。针对八纲辨证的功效：是指中药的某些功效分别与八纲辨证的各纲辨证相对应。如对应表里辨证的有解表、发表、温里、攻里等；对应寒热辨证的有散表热、清里热、散表寒、散里寒等；对应虚实辨证的有补虚、泻实等；对应阴阳辨证的有补阴、滋阴、敛阴、补阳、助阳、温阳、回阳等。伤津（E错）为苦味药的不良作用。苦味药大多能伤津、伐胃，津液大伤及脾胃虚弱者不宜大量用。